工艺成熟、反应稳定、成批生产的药品收载于
A. 中国药典
B. 卫生部药品标准
C. 两者均是
D. 两者均不是

正确答案：A。中国药典

解析：本题考查中国药典。工艺成熟、反应稳定、成批生产的药品收载于中国药典（A对）。国家基本药物目录中的化学药品、生物制品、中成药，应当是《中华人民共和国药典》收载的，国家食品药品监管部门、原卫生部公布药品标准的品种。